患者男性，20岁，骑自行车转弯时不慎与对面行驶过来的小汽车发生碰撞，颏部着地。检查：神清，颏部皮肤裂开，渗血，耳前区肿胀、有压痛，张口度1.5cm，后牙早接触，前牙开（牙合），咬合关系紊乱。为确诊还需检查
A. 颞下颌关节张闭口位
B. 全口牙位曲面体层X线片
C. 颞下颌关节MRI
D. 颞下颌关节CT
E. 下颌骨正位片

正确答案：D。颞下颌关节CT

解析：本题考查牙槽突骨折、颌骨骨折。颞下颌关节CT（D对）能正确反映颞下颌关节的骨折情况，包括骨折部位、方向等。